治疗热淋涩痛，应选用
A. 大黄
B. 芦荟
C. 番泻叶
D. 甘遂
E. 大戟

正确答案：A。大黄

解析：热淋涩痛，治益清热泻火，凉血解毒，导湿热外出。大黄具有泻下攻积，清热泻火，凉血解毒，逐瘀通经的功效亦能导湿热外出（A对）。芦荟具有泻下通便，清肝，杀虫的功效，无导湿热外出之功（B错）。番泻叶具有泻下通便的功效，无导湿热外出之功（C错）。甘遂具有泻水逐饮，消肿散结的功效，无导湿热外出之功（D错）。大戟具有泻下逐水，消肿散结的功效，无导湿热外出之功（E错）。